男，30岁，发现右肾积水1个月。既往有肺结核史，已治愈。查体：消瘦体型。尿液结核菌涂片：抗酸杆菌（＋）。该疾病最常见的临床症状为
A. 腰痛
B. 发热
C. 贫血
D. 尿频，尿急，尿痛
E. 盗汗

正确答案：D。尿频，尿急，尿痛

解析：青年男性患者，尿液结核菌涂片：抗酸杆菌（＋）。考虑诊断为肾结核。肾结核最常见的临床症状为尿频，尿急，尿痛（D对）。其余选项（ABCE错）均不是最常见的临床症状。